下列有关颞下间隙的境界描述，正确的是
A. 前界为上颌骨后面
B. 内界为蝶骨翼突外侧板
C. 外界为下颌支上份及颧弓
D. 后界为茎突及茎突诸肌
E. 以上均正确

正确答案：E。以上均正确

解析：颞下间隙位于翼下颌间隙上方。前界为上颌骨后面，后界为茎突及茎突诸肌，内界为蝶骨翼突外侧板，外界为下颌支上份及颧弓，上界为蝶骨大翼的颞下面和颞下嵴，下以翼外肌下缘平面为界。掌握“面侧深区及颌面部各间隙的境界”知识点。